收集丈夫或自愿献精者的精液，由医师注入女性生殖道，达到受孕的技术是
A. 体外受精
B. 克隆技术
C. 人工授精
D. 异体受孕
E. 代孕母亲

正确答案：C。人工授精

解析：人工授精：收集丈夫或自愿献精者的精液，由医师注入女性生殖道，以达到受孕目的的一种技术。掌握“人类生殖技术伦理”知识点。